腮腺分泌量占唾液分泌总量的比例是
A. 2%～4%
B. 7%～8%
C. 22%～30%
D. 41%～55%
E. 60%～65%

正确答案：C。22%～30%

解析：本题考查唾液的分泌。腮腺分泌量占唾液分泌总量的比例是22%～30%（C对）。正常成人每天的唾液分泌量为1000～1500mL，其中的绝大多数来自三对大唾液腺。在无任何刺激的情况下，唾液的基础分泌为每分钟0.5mL。下颌下腺静止时分泌量最大，占60%～65%（E错）；腮腺占22%～30%，但对于进食等刺激的反应大于下颌下腺；舌下腺约占2%～4%（A错）；小唾液腺约占7%～8%（B错）。